某男，31岁。患酒皶鼻、粉刺。宜选用的外用药组是
A. 大黄配芒硝
B. 大黄配干姜
C. 白矾配雄黄
D. 硫黄配大黄
E. 大黄配巴豆

正确答案：D。硫黄配大黄

解析：本题考查的是硫黄的配伍。某男，31岁。患酒皶鼻、粉刺。宜选用的外用药组是硫黄配大黄（D对）。硫黄：【配伍】硫黄配大黄：硫黄酸温有毒，功能解毒杀虫止痒；大黄苦寒清泄，功能清热活血消肿。两药相配，外用善清热杀虫、燥湿止痒，治酒皶鼻、粉刺。大黄：【配伍】大黄配芒硝（A错）：大黄苦寒，功能泻下攻积、清热泻火、解毒；芒硝咸寒，功能泻下、软坚、清热。两药相配，既善泻下攻积，又善润软燥屎，还善清热泻火，治实热积滞、大便燥结、坚硬难下效佳。大黄配巴豆、干姜（BE错）：大黄苦寒，功善泻热通便、攻积导滞；巴豆辛热，功善峻下冷积；干姜辛热，功善温中散寒。三药相配，巴豆得大黄，其泻下之力变缓和而持久；大黄得巴豆，其寒性可去；再加温中散寒之干姜，以助散寒之力。故善治寒积便秘。雄黄：【配伍】雄黄配白矾（C错）：雄黄辛苦温燥，功善解毒杀虫止痒；白矾酸涩性寒，功能收湿止痒，解毒杀虫。两药相配，寒温并用，研末外用可增解毒收湿止痒之功，可治湿疹、疥癣瘙痒等证。